有关DIC的发展过程下列描述不妥的是
A. 依次分为高凝期、消耗性低凝期和继发性的纤溶亢进期
B. 在高凝期血液中的凝血酶大量生成
C. 消耗性的低凝期有出血现象
D. 任何一期都不形成微血栓
E. 继发性纤溶亢进期有明显的出血现象

正确答案：D。任何一期都不形成微血栓

解析：依次分为高凝期、消耗性低凝期和继发性的纤溶亢进期（A对）是DIC的发展过程的分期。在高凝期血液中的凝血酶大量生成（B对）是各种病因导致凝血系统激活所致，血液凝固性异常增高，微循环中形成大量微血栓。消耗性的低凝期有出血现象（C对）是因为大量凝血酶的产生和微血栓形成，使凝血因子和血小板被大量消耗，同时可能继发性激活纤溶系统，使血液处于消耗性低凝状态。继发性纤溶亢进期有明显的出血现象（E对）是因为产生的大量凝血酶及 F XIIa 等激活了纤溶系统，产生大量纤溶酶，导致纤溶亢进和 FDP的形成。高凝期可形成微血栓（D错，为本题正确答案）